对于我国60岁及以上的老年人群，最常见的伤害类型是
A. 溺水
B. 自杀
C. 跌倒
D. 交通事故
E. 非故意的机械性窒息

正确答案：C。跌倒